利福平易引起
A. 药源性急性胃溃疡
B. 药源性肝病
C. 药源性耳聋
D. 药源性心血管损害
E. 药源性血管神经性水肿

正确答案：B。药源性肝病

解析：本题考查药源性疾病。利福平易引起药源性肝病（B对）；引起药源性耳聋（C错）的药物有：氨基糖苷类抗生素、非甾体抗炎药等；引起药源性心血管损害（D错）的药物有：强心苷、麻黄碱、奎尼丁等；引起药源性血管神经性水肿（E错）的药物有：卡托普利、依那普利等。